有完整细胞核的微生物是
A. 立克次氏体
B. 放线菌
C. 细菌
D. 真菌
E. 衣原体

正确答案：D。真菌

解析：本题考查微生物的种类。有完整细胞核的微生物是真菌（D对）。立克次氏体（A错）、放线菌（B错）、细菌（C错）、衣原体（E错）属于原核细胞型微生物，无完整细胞核，细胞器不完善。